接种过乙型肝炎疫苗或感染过乙型肝炎病毒（HBV）已完全康复者的标志是
A. 仅血清HBsAg阳性
B. 血清HBsAg、HBeAg阳性或抗-HBe阴性、抗-HBc阳性
C. 血清抗-HBs和抗-HBc阳性，抗-HBe阴性或阳性
D. 血清HBsAg和抗-HBc阳性，而HBeAg一直为阴性
E. 仅血清抗-HBs阳性

正确答案：E。仅血清抗-HBs阳性